下列各项，不符合瘀胆型肝炎临床表现的是
A. 黄疸深
B. 自觉症状重
C. 皮肤瘙痒
D. 大便颜色变浅
E. 血清胆固醇升高

正确答案：B。自觉症状重

解析：瘀胆型肝炎主要表现为肝内瘀胆，肝细胞坏死、炎症病变相对较轻。起病类似急性黄疸型肝炎，自觉症状常较轻（B错，为本题正确答案），而有皮肤瘙痒（C对），大便灰白（D对），常有明显肝脏肿大，肝功能检查血清胆红素明显升高，以直接胆红素为主，凝血酶原活动度>60%或应用维生素K肌注后一周可升至60%以上，血清胆汁酸、γ～谷氨酰转肽酶、碱性磷酸酶、胆固醇水平升高（E对），黄疸深（A对）且持续3周以上